患者，男，45岁，因社区获得性肺炎入院，入院时9月8日查血常规提示：血小板（PLT）88X/L，9月9日开始给予左氧氟沙星抗感染治疗一周后肺炎治愈，9月11查血小板（PLT）90X/L，9月20日查血常规提示：血小板（PLT）92X/L，患者既往血常规情况不详。该患者血小板减少与氧氟沙星的因果关系评价结果是
A. 肯定
B. 很可能
C. 可能
D. 可能无关
E. 无法评价

正确答案：E。无法评价

解析：本题考查药品不良反应的评定结果。不良反应评价结果有6级，其中无法评价（E对）是指报表缺项太多，因果关系难以定论，资料又无法补充。本题中患者符合无法评价结果。肯定（A错）是指用药及反应发生时间顺序合理；停药以后反应停止，或迅速减轻或好转；再次使用，反应再现，并可能明显加重；有文献资料佐证；排除原患疾病等其它混杂因素影响。很可能（B错）是指无重复用药史，或虽然有合并用药，但基本可排除合并用药导致反应发生的可能性。可能（C错）是指用药与反应发生时间关系密切，同时有文献资料佐证；但引发ADR的药品不止一种，或原患疾病的病情进展因素不能排除。可能无关（D错）是指ADR与用药时间相关性不密切，反应表现与已知该药ADR不相吻合，原患疾病发展同样可能有类似的临床表现。